龋病最好发的部位是
A. 平滑面龋
B. 窝沟龋
C. 根面龋
D. 牙本质龋
E. 牙骨质龋

正确答案：B。窝沟龋

解析：本题考查牙釉质龋。龋病最好发的部位是窝沟龋（B对）。咬合面点隙窝沟是食物、菌斑滞留区，且不易清洁，故窝沟是龋病最好发的部位，形成窝沟龋。